某学校组织全体师生参观地震博物馆，并进行紧急疏散演习，是为了提高大家的
A. 学校卫生政策
B. 学校物质环境
C. 学校社会环境
D. 个人健康技能
E. 卫生服务

正确答案：D。个人健康技能